适宜用开窍剂治疗的症候是
A. 阳明腑实，神昏谵语
B. 阴虚风动，神倦瘛瘲
C. 瘀热扰神，谵语如狂
D. 热陷心包，窍闭神昏
E. 火毒扰神，错语不眠

正确答案：D。热陷心包，窍闭神昏

解析：热陷心包，窍闭神昏，治益清心凉营，开窍醒神，故选用开窍药（D对）。阳明腑实，神昏谵语，治益清热泻火，故选用泻下药（A错）。阴虚风动，神倦瘛瘲由肝阴虚引起，治益滋养阴液，故选用补阴药（B错）。瘀热扰神，谵语如狂，本症见于痰火内盛，闭扰心神之痰火扰神证，故应选用清热化痰药（C错）。火毒扰神，错语不眠，治益清解火热毒邪，故选用清热解毒药（E错）。